男，24岁，一小时前工作中右小腿被机器割伤，伤口无活动性出血，右小腿及右足血运正常，右侧足背前内侧感觉障碍，最可能损伤的神经是
A. 股神经
B. 胫神经
C. 腓肠神经
D. 腓总神经
E. 隐神经

正确答案：D。腓总神经

解析：患者男，24岁，一小时前工作中右小腿被机器割伤，伤口无活动性出血，右小腿及右足血运正常，右侧足背前内侧感觉障碍（腓总神经损伤的表现），结合患者的表现，最可能损伤的神经是腓总神经（D对）。